功能活血散结、止痛的药物是
A. 麝香
B. 冰片
C. 两者均是
D. 两者均不是

正确答案：A。麝香

解析：本题考查的是麝香的功效。功能活血散结、止痛的药物是麝香（A对）。麝香：【功效】开窍醒神，活血通经，消肿止痛。冰片（B错）：【功效】开窍醒神，清热止痛。